与大脑半球肿瘤临床表现不符的是
A. 多尿
B. 进行性感觉障碍
C. 癫痫发作
D. 精神症状
E. 视野缺损

正确答案：A。多尿

解析：多尿（A错，为本题正确答案）为下丘脑受损的表现，肿瘤累及下丘脑，引起抗利尿激素分泌减少。中央前后回肿瘤可发生一侧肢体运动和进行性感觉障碍（ B对）；额叶肿瘤常有精神症状（ D对）；枕叶肿瘤可引起视野缺损（ E对）。额叶肿瘤与癫痫发作（ C对）有关。